促进尿酸排泄的抗痛风药物是
A. 双氯芬酸
B. 秋水仙碱
C. 苯溴马隆
D. 双醋瑞因
E. 非布司他

正确答案：C。苯溴马隆

解析：本题考查苯溴马隆的药理作用。苯溴马隆（C对）为促进尿酸排泄药，可用于治疗原发性高尿酸血症、痛风性关节炎以及痛风结节，有效的促进尿酸排出，缓解痛风症状。